关于糖皮质激素的应用，下列哪项是错误的
A. 水痘和带状疱疹
B. 风湿和类风湿性关节炎
C. 血小板减少症和再生障碍性贫血
D. 过敏性休克和心源性休克
E. 中毒性肺炎，重症伤寒和急性粟粒性肺结核

正确答案：A。水痘和带状疱疹

解析：糖皮质激素临床应用：①严重感染或炎症。②自身免疫性疾病、过敏性疾病和器官移植排斥反应。③抗休克治疗。④血液病。⑤局部应用。⑥替代疗法。因为水痘和带状疱疹属于病毒感染，不是细菌感染引起的炎症，故使用糖皮质激素无效果。掌握“糖皮质激素”知识点。